关于血浆AG,不正确的是
A. 是血浆中未测定的阴离子与未测定的阳离子差值
B. 正常范围是10-14mmol/L
C. 通过AG对代谢性酸中毒分类
D. 无助于混合型酸碱平衡紊乱的诊断
E. 硫酸根等固定酸根增多，AG增大

正确答案：D。无助于混合型酸碱平衡紊乱的诊断

解析：血浆AG是血浆中未测定的阴离子与未测定的阳离子差值（A对），正常范围是10-14mmol/L（B对），可以通过AG对代谢性酸中毒分类（C对）并判断混合型酸碱平衡紊乱（D错，为本题正确答案），当AG>16 mmol/L时提示有AG增高型代谢性酸中毒。固定酸增多时，其固定酸的H+被HC03-缓冲，其酸根增高。这部分酸根均属没有测定的阴离子，所以AG值增大（E对）。